引起急性化脓性梗阻性胆管炎最常见的原因是
A. 胆囊结石
B. 胆管结石
C. 胆囊癌
D. 胆管癌
E. 胆道蛔虫

正确答案：B。胆管结石

解析：急性化脓性梗阻性胆管炎的发病基础是胆道梗阻和细菌感染。引起胆道梗阻最常见的原因是胆管结石（B对），也就是引起急性化脓性梗阻性胆管炎最常见的原因。胆囊结石（A错）、胆囊癌（C错）不易引起胆管阻塞，不易引起急性化脓性梗阻性胆管炎。临床上，胆管癌（D错）、胆道蛔虫（E错）可压迫或阻塞胆管，当消化道大肠埃希菌等感染时，可引起急性化脓性梗阻性胆管炎，但较为少见。